老年人服用二甲双胍时不宜同时服用的中成药是
A. 麝香保心丸
B. 六味地黄丸
C. 人参鹿茸丸
D. 银杏叶制剂
E. 柴胡舒肝丸

正确答案：C。人参鹿茸丸

解析：本题考查的是老年人合理应用中药的原则。老年人服用二甲双胍时不宜同时服用的中成药是人参鹿茸丸（C对）。老年人合理应用中药的原则：1.辨证论治，严格掌握适应证：老年人体虚多病，病情往往复杂多变，若药物使用不当可使病情急转直下，甚至无法挽救，故首先应明确是否需要进行药物治疗。对有些病证可以不用药物治疗的就不用，更不要滥用。2.熟悉药品，恰当选择应用：由于老年人的靶器官或细胞的敏感性增强，使他们对药物的反应比年轻人强烈，特别是对中枢神经抑制药物、降血糖药物、心血管系统药物反应特别敏感，在正常剂量下的不良反应增加，甚至出现药源性疾病，因此在联合用药中应高度重视。如麝香保心丸（A错）与地高辛等强心类药物联合用药，由于麝香保心丸中所含蟾酥的基本化学结构与强心苷相似，在化学结构上有相似之处，故具有与强心苷类药物地高辛相似的强心作用，联合应用势必会造成相同或相似功效的累加，产生拟似效应，诱发强心苷中毒，出现频发性早搏等心律失常等不良反应。常有一些患有胃病的老年患者将银杏叶及其提取物制剂（D错）和法莫替丁片同时服用。法莫替丁片为抗溃疡抗酸药，与含有多量黄酮类成分的银杏叶制剂同时服用可产生络合效应，形成螯合物，影响疗效。因此，在服用抗酸类西药时应避免与含黄酮类的中药如复方丹参片、复方丹参滴丸、银杏叶片等同服，应分时应用，一般来讲，以间隔1小时为宜。患有糖尿病的心脑血管患者用培元通脑胶囊、益心通脉颗粒、活血通脉片等含有甘草、人参、鹿茸等成分的中成药，可使降糖药的疗效降低。因为，甘草、人参、鹿茸具有糖皮质激素样作用，可以促进糖原异生，升高血糖，与降糖药二甲双胍、消渴丸、阿卡波糖和胰岛素产生拮抗作用，导致降糖效果降低。因此，要尽量准确了解老年患者的用药情况，对此类患者尽量选用不含此类成分的中成药。如必须并用，应适当加大降糖药的剂量，并密切注意患者的血糖变化，避免加重患者的病情。此外，含有糖皮质激素样物质的中药甘草、鹿茸应避免与阿司匹林合用，防止加重对胃黏膜的损伤。3.选择合适的用药剂量：老年人肝肾功能多有不同程度的减退或合并多器官严重疾病。因此，用药要因人而异，一般应从“最小剂量”开始。尤其对体质较弱，病情较重的患者切不可随意加药。六味地黄丸（B错）为肾虚老人宜用的中成药。柴胡舒肝丸（E错）为胁痛肝郁气滞证的中成药应用。胁痛肝郁气滞证：【中成药应用】常用中成药有柴胡舒肝丸、四逆散、舒肝止痛丸。